关于半膜肌，正确的是
A. 是髋关节的外展肌
B. 有两个头
C. 止于腓骨
D. 受股神经支配
E. 半屈膝时可以使膝关节旋内

正确答案：E。半屈膝时可以使膝关节旋内

解析：半膜肌屈膝、伸髋，使已屈的膝关节内旋，即半屈膝时可以使膝关节旋内（E对），并非髋关节的外展肌（A错），仅有一个头，而非两个头（B错），止于胫骨，而非腓骨（C错），受坐骨神经支配，而非股神经（D错）。